下列经脉循行除哪项外，都经过心
A. 手厥阴经
B. 手少阳经
C. 手太阳经
D. 手阳明经
E. 足少阴经

正确答案：D。手阳明经

解析：手厥阴心包经（A对）起于心中；手少阳三焦经（B对）经脉散络于心包；手太阳小肠经（C对）交会于大椎，向下进入缺盆部，联络心脏；足少阴肾经（E对）其支脉从肺出来络心，注入胸中。只有手阳明大肠经未经过心第（D错，为本题正确答案）。